下列哪项不是酸蚀症的致病因素
A. 饮食酸性饮料
B. 酸性药物
C. 胃酸
D. 树脂修复前的酸蚀凝胶
E. 职业相关酸性物质

正确答案：D。树脂修复前的酸蚀凝胶

解析：酸蚀症主要是酸性物质对牙组织的脱矿作用。酸性物质包括以下各项：饮食酸性饮料、职业相关酸性物质、酸性药物、胃酸。掌握“酸蚀症”知识点。